男性，12岁，昨晚进食海鲜，今晨开始畏寒、发热、腹痛，以左下腹甚，腹泻伴明显里急后重，大便8次，初次稀便，继之为黏液脓血便，对该病例首先采用的抗菌药物是
A. 四环素
B. 喹诺酮类
C. 氯霉素
D. 庆大霉素
E. 头孢曲松

正确答案：E。头孢曲松

解析：12岁患儿，患者食海鲜后畏寒、发热、腹痛，以左下腹甚，腹泻伴明显里急后重，排便初为稀便，继之为黏液脓血便，应诊断为急性细菌性痢疾普通型（典型），对该病例首先采用的抗菌药物是头孢曲松（B对）。